女45岁。肛门肿胀1周。为持续性痛，逐渐加痛，排便和行走时出现剧痛，有里急后重感和排便困难，伴发热，全身不适。查体：T39.6℃，肛门左侧红肿，有明显压痛，直肠指诊：直肠左侧饱满，压痛（+），有波动感。血常规：Hb102g/L，WBC21.0×10⁹/L，NO0.92，Plt210×10⁹/L。决定立即行切开引流术，最主要的依据是
A. 排便有困难
B. 局部饱满有波动感
C. 高热，全身症状
D. 血白细胞增高
E. 行走时出现剧痛

正确答案：B。局部饱满有波动感

解析：中年女性患者，肛门肿胀1周。为持续性痛，逐渐加重，排便和行走时出现剧痛，由里急后重感和排便困难，伴发热，全身不适。查体：T39.6℃（属于高热，正常腋温36～37℃），肛门左侧红肿，有明显压痛，直肠指诊：直肠左侧饱满，压痛（+），有波动感。血常规：Hb102g/L（Hb正常值为110g/L），WBC21.0×10⁹/L（正常值为（4～10）×10⁹/L），NO0.92（正常值为0.40～0.75），Plt210×10⁹/L（正常范围是（100～300）×10⁹/L），为全身感染症状，根据患者症状体征和实验室检查，考虑诊断为坐骨肛管间隙脓肿。此时决定立即行切开引流术，最主要的依据是局部饱满有波动感（B对）。坐骨肛管间隙脓肿发病时排便有困难（A错），可出现高热，全身症状（C错，），血白细胞增高（D错），行走时出现剧痛（E错），这些虽为坐骨肛管间隙脓肿的临床表现，但都不是最主要的表现，不可作为切开引流术的依据。